影响健康的社会经济环境不包括
A. 个人健康状况
B. 社会地位
C. 文化背景
D. 社会支持网络
E. 受教育程度

正确答案：A。个人健康状况

解析：影响健康的社会经济环境：包括个人收入和社会地位、文化背景和社会支持网络、受教育程度、就业等。掌握“预防医学概论、健康及三级预防策略”知识点。